一个操纵子通常含有
A. 一个启动序列和一个编码基因
B. 一个启动序列和数个编码基因
C. 数个启动序列和一个编码基因
D. 数个启动序列和数个编码基因
E. 两个启动序列和数个编码基因

正确答案：B。一个启动序列和数个编码基因